患者，女，30岁，已婚。经期延后，量少，色暗红，有小血块，小腹胀痛，伴胸胁乳房胀痛，现月经中断3个月余，尿妊娠试验阴性，舌苔薄白脉弦。治疗应首选
A. 调肝汤
B. 柴胡疏肝散
C. 少腹逐瘀汤
D. 乌药汤
E. 桃红四物汤

正确答案：D。乌药汤

解析：患者抑郁伤肝，气机不畅，血为气滞，胞宫、血海不能按时满溢，故经行后期，经量减少，或有血块；肝郁气滞，经脉壅阻，故小腹胸胁乳房胀痛。可见是月经后期气滞证，气滞日久，血瘀不行，3月余后，出现闭经，苔薄白脉弦，非妊娠期，故为闭经气滞血瘀证，治疗理气活血，祛瘀止痛，治疗选用乌药汤（D对）。调肝汤用益肾调经，养血止痛。主治痛经肾气亏损证（A错）。柴胡疏肝散功用疏肝行气、活血止痛。主治肝气郁滞证。胁肋疼痛，胸闷喜太息，情志抑郁易怒，或嗳气，脘腹胀满，脉弦。根据题目可知，患者情志变化不明显，没有肝气郁滞的明显征象（B错）。少腹逐瘀汤功用活血祛瘀，温经止痛。主治痛经寒凝血淤证（C错）。桃红四物汤公用活血化瘀调经。主治月经过少血瘀证（E错）。